医药经营企业的药品质量验收记录
A. 可以用铅笔填写
B. 不得撕毁
C. 确实需涂改时，应划去后在旁边重写，在划处盖本人图章和日期
D. 签名可以只写姓氏
E. 无内容填写时可空格

正确答案：B、C。不得撕毁；确实需涂改时，应划去后在旁边重写，在划处盖本人图章和日期

解析：本题考查药品验收。医药经营企业的药品质量验收记录不得撕毁（B对），确实需涂改时，应划去后在旁边重写，在划处盖本人图章和日期（C对）。验收药品应当做好验收记录，包括药品的通用名称、剂型、规格、批准文号、批号、生产日期、有效期、生产厂商、供货单位、到货数量、到货日期、验收合格数量、验收结果等。药品质量验收记录不得撕毁或任意涂改记录，确实需涂改时，应划去后在旁边重写，在划处盖本人图章和日期；字迹清楚，内容真实完整，不得用铅笔填写记录（A错）；签名要写全名，不得只写姓氏（D错）；不得空格漏项，如无内容填写一律用“”表示（E错）。